患者，男，2岁，体重15kg，诊断为“1型糖尿病”，可使用降糖药物是
A. 格列美脲
B. 阿卡波糖
C. 二甲双胍
D. 比格列酮
E. 胰岛素

正确答案：E。胰岛素

解析：本题考查胰岛素。患者，男，2岁，体重15kg，诊断为“1型糖尿病”，可使用降糖药物是胰岛素（E对）。胰岛素主要用于糖尿病，特别是1型糖尿病的治疗，可用于纠正细胞内缺钾。格列美脲（A错）适用于控制饮食、运动疗法及减轻体重均不能满意控制血糖的2型糖尿病。阿卡波糖（B错）配合饮食控制，用于治疗糖尿病，或降低糖耐量低减者的餐后血糖。二甲双胍（C错）用于单纯饮食控制不满意的Ⅱ型糖尿病病人，尤其是肥胖和伴高胰岛素血症者，用本药不但有降血糖作用，还可能有减轻体重和高胰岛素血症的效果。吡格列酮（D错）用于2型糖尿病的控制与改善。